交通支叙述错误的是
A. 分为灰、白交通支
B. 白交通支内含有节前纤维
C. 灰交通支内含有节后纤维
D. 胸、腰神经均有白交通支相连
E. 脊神经均有灰交通支相连

正确答案：D。胸、腰神经均有白交通支相连

解析：交通支分为灰、白交通支（A对），白交通支由发自脊神经进入交感干的有髓神经纤维构成，其纤维成分属于内脏运动纤维，源于脊髓灰质侧角的多极神经元，含有节前纤维（B对）。灰交通支为发自交感干的无髓神经纤维，由起于交感干的节后神经纤维构成（C对），胸、腰神经（D错，为本题正确选项）由脊神经组成，而交通支为连于脊神经与交感干之间的细支。